询问病史的道德要求最主要的是
A. 全面系统，认真细致
B. 综合分析，切忌片面
C. 全神贯注，语言得当
D. 合理配伍，细致观察
E. 精诚团结，密切协作

正确答案：C。全神贯注，语言得当